能引起人畜共患传染病的细菌是
A. 大肠杆菌
B. 白喉棒状杆菌
C. 肉毒杆菌
D. 布鲁司杆菌
E. 鸡沙门菌

正确答案：D。布鲁司杆菌